下列过程中，属于适应性免疫应答的是
A. 吞噬细胞吞噬病原体
B. 树突状细胞进行病原体提呈
C. NK细胞杀伤病原体
D. APC识别病原体
E. 免疫应答过程中释放免疫球蛋白

正确答案：E。免疫应答过程中释放免疫球蛋白

解析：抗原诱导的免疫应答具有抗原特异性，即抗原刺激机体产生适应性免疫应答及其与应答效应产物发生结合均显示专一性，某特定抗原只能刺激机体产生针对该抗原的活化T/B细胞或抗体，且仅能与该淋巴细胞或抗体发生特异性结合。故答案选择免疫应答过程中释放免疫球蛋白（E对）。